关于朱砂性能特点与用法用量的说法，错误的是
A. 质重镇怯
B. 甘寒清解
C. 成人日服用量为0.5～1g
D. 不入煎剂
E. 有毒而力强

正确答案：C。成人日服用量为0.5～1g

解析：本题考查的是朱砂的性能特点与用法用量。朱砂的成人日服用量为0.1～0.5g（C错，为本题正确答案）。朱砂：【性能特点】本品甘寒清解（B对），质重镇怯（A对），有毒而力强（E对），专入心经。善重镇安神，为治心火亢盛诸证之要药，无论虚实皆宜；能清热解毒，为治热毒疮肿、咽痛、口疮所常用。【用法用量】内服：研末冲，或入丸散，0.1～0.5g；不入煎剂（D对）。外用：适量，干掺，或调敷，或喷喉。